龙胆苦苷的结构类型是
A. 皂苷
B. 黄酮苷
C. 二萜苷
D. 环烯醚萜苷
E. 强心苷

正确答案：D。环烯醚萜苷

解析：本题考查的是龙胆苦苷的结构类型。龙胆苦苷的结构类型是环烯醚萜苷（D对）。龙胆含有的主要有效成分为裂环环烯醚萜苷类化合物，如獐牙菜苷、獐牙菜苦苷和龙胆苦苷等。此外还含有生物碱、黄酮、香豆素及内酯等化合物。《中国药典》以龙胆苦苷为指标成分进行含量测定，龙胆中含量不得少于3.0%；坚龙胆中含量不得少于1.5%。皂苷（A错）是一类结构复杂的苷类化合物，其苷元为具有螺甾烷及其有相似生源的甾族化合物或三萜类化合物。大多数皂苷水溶液用力振荡可产生持久性的泡沫。故称为皂苷。皂苷在自然界中分布很广，约有一半植物中含有皂苷，其中以薯蓣科、百合科、毛茛科、五加科、伞形科和豆科等分布最为广泛。近年来，从一些海洋生物中如海参、海星等，亦分离得到了皂苷类化合物。黄酮苷（B错）：天然黄酮类化合物多以苷类形式存在，并且由于糖的种类、数量、连接位置及连接方式的不同，可以组成各种各样的黄酮苷类。二萜苷（C错）：二萜多以树脂、内酯或苷的形式广泛存在于自然界。强心苷（E错）是存在于生物界中的一类对心脏有显著生理活性的甾体苷类。主要分布于夹竹桃科、玄参科、百合科、萝藦科、十字花科、毛茛科和桑科等。